髓核易向哪个方向脱出
A. 左方
B. 右方
C. 前外侧
D. 后外侧
E. 无

正确答案：D。后外侧

解析：由于髓核的后外侧是椎间孔或椎管。所以纤维环破裂时髓核容易向后外侧（D对）突出。